具有抗纤维蛋白溶解作用的促凝血酶是
A. 卡巴克洛
B. 维生素K₁
C. 血凝酶
D. 鱼精蛋白
E. 氨甲环酸

正确答案：E。氨甲环酸

解析：本题考查氨甲环酸。氨甲环酸（E对）为具有抗纤维蛋白溶解作用的促凝血酶。卡巴克洛（A错）可增强毛细血管对损伤的抵抗力，降低毛细胞血管的通透性。维生素K₁（B错）能够促进凝血因子的合成。血凝酶（C错）能促进血管破损部位的血小板聚集。鱼精蛋白（D错）可特异性拮抗肝素的抗凝作用。